引起肾综合征出血热的病原体是
A. 汉坦病毒
B. 登革病毒
C. 新疆出血热病毒
D. 黄热病毒
E. Lassa病毒

正确答案：A。汉坦病毒

解析：引起肾综合征出血热的病原体是汉坦病毒（A对），汉坦病毒在临床上主要引起两种急性传染病，一种是肾综合征出血热，另一种是汉坦病毒肺综合征。登革病毒（B错）是登革热的病原体（P92）。新疆出血热病毒（C错）是新疆出血热的病原体。黄热病毒（D错）是黄热病的病原体（八版医学微生物学P286表30-1）。Lassa病毒（E错）是Lassa热的病原体（八版医学微生物学P286表30-1）。